某男，42岁。自诉咽中如有物阻，呕吐不出，吞咽不下，胸胁满闷，化痰降硬，处以半夏厚朴；其药物构成为姜半夏、茯苓、厚朴、生姜、紫苏叶。处方调配复核，见有不规则形片块，长1～2cm，表面白色至类白色，略粗糙或平坦，质坚硬，气微的饮片是
A. 生姜
B. 茯苓
C. 厚朴
D. 姜半夏
E. 紫苏叶

正确答案：B。茯苓

解析：本题考查的是茯苓的饮片鉴别。处方调配复核，见有不规则形片块，长1～2cm，表面白色至类白色，略粗糙或平坦，质坚硬，气微的饮片是茯苓（B对）。茯苓：【性状鉴别】饮片茯神为类方形的片块。表面白色至类白色，较平坦，中间或一侧有类圆形松根木。质硬，折断面较粗糙。厚朴（C错）：【性状鉴别】饮片呈弯曲的丝条状或单、双卷筒状。外表面灰褐色，有时可见椭圆形皮孔或纵皱纹。内表面紫棕色或深紫褐色，较平滑，具细密纵纹，划之显油痕。切面颗粒性，有油性，有的可见小亮星。气香，味辛辣、微苦。姜半夏（D错）：【性状鉴别】饮片呈片状、不规则颗粒状或类球形。表面棕色至棕褐色。质硬脆，断面淡黄棕色，常具角质光泽。气微香，味淡，微有麻舌感，嚼之略粘牙。紫苏叶（E错）：【性状鉴别】饮片呈不规则的段或未切叶。叶多皱缩弯曲、破碎，完整者展平后呈卵圆形。边缘具圆锯齿。两面紫色或上表面绿色，下表面紫色，疏生灰白色毛。叶柄紫色或紫绿色。气清香，味微辛。生姜（A错）的性状鉴别，2022年考试指南未明确说明。